临终关怀的根本目的是为了
A. 节约卫生资源
B. 减轻家庭的经济负担
C. 提高临终病人的生存质量
D. 缩短病人的生存时间
E. 防止病人自杀

正确答案：C。提高临终病人的生存质量

解析：临终关怀是一种“特殊服务”，即对临终患者及其家属所提供的一种全面照护，目的是使临终患者的生存质量得到提高。掌握“临终关怀伦理”知识点。